下列方剂组成药物中，不含有附子的是
A. 实脾散
B. 真武汤
C. 乌梅丸
D. 温脾汤
E. 阳和汤

正确答案：E。阳和汤

解析：本题考查五个方剂的药物组成，属记忆内容。阳和汤功效温阳补血，散寒通滞，由熟地黄、麻黄、鹿角胶、白芥子、肉桂、生甘草、炮姜炭组成，不含有附子，故E为正确答案。实脾散功用温阳健脾，行气利水，由厚朴、白术、木瓜、木香、草果仁、大腹子、附子、白茯苓、干姜、甘草组成，含有附子。真武汤功用温阳利水，由茯苓、芍药、白术、生姜、附子组成，含有附子。乌梅丸功用温脏安蛔，由乌梅、细辛、干姜、黄连、当归、附子、蜀椒、桂枝、人参、黄柏组成，含有附子。温脾汤功用攻下冷积，温补脾阳，由大黄、当归、干姜、附子、人参、芒硝、甘草组成，含有附子。趣记：阳和汤，甘麻芥炭鹿肉熟 [寓意]干妈借炭鹿肉熟。